大黄䗪虫丸处方组成为大黄、土鳖虫、水蛭、虻虫、蛴螬、干漆、桃仁、地黄、白芍、黄芩、苦杏仁、甘草。方中大黄宜选用的炮制品是
A. 生大黄
B. 酒大黄
C. 醋大黄
D. 熟大黄
E. 大黄炭

正确答案：D。熟大黄

解析：本题考查的是大黄䗪虫丸的药物组成。大黄䗪虫丸处方组成为大黄、土鳖虫、水蛭、虻虫、蛴螬、干漆、桃仁、地黄、白芍、黄芩、苦杏仁、甘草。方中大黄宜选用的炮制品是熟大黄（D对）。生大黄（A错）、酒大黄（B错）、熟大黄与大黄炭（E错）均为大黄的不同炮制品种，由于炮制方法不同，作用亦各有偏重。生大黄泻下力强，故欲攻下者宜生用，汤剂应后下，或用开水泡服；久煎则泻下力减弱。酒大黄泻下力较弱，善清上焦血分热毒，宜用于目赤咽肿，齿龈肿痛。熟大黄泻下力缓，泻火解毒，用于火毒疮疡。大黄炭凉血化瘀止血，多用于血热有瘀出血证。如温脾汤用生大黄、当归龙荟丸用酒大黄、大黄䗪虫丸用熟大黄、十灰丸用大黄炭。